医德评价的标准不包含
A. 有利
B. 自主
C. 公正
D. 互助
E. 奉献

正确答案：E。奉献